血府逐瘀汤中的臣药是
A. 桃仁  红花
B. 赤芍  川芎
C. 生地  当归
D. 桔梗  枳壳
E. 柴胡  甘草

正确答案：B。赤芍  川芎

解析：血府逐瘀汤中的臣药是赤芍、川芎助君药活血祛瘀（B对）。桃仁破血行滞而润燥，红花活血祛瘀以止痛，共为君药（A错）。生地、当归养血益阴，清热活血，为佐药（C错）。桔梗、枳壳，一升一降，宽胸行气为佐药（D错）。柴胡疏肝解郁，升达清阳为佐药，甘草调和诸药为使药（E错）。